不属于垂体腺瘤的体征的是
A. 视神经萎缩
B. 双颞侧偏盲
C. 停经、泌乳
D. 肢端肥大
E. 癫痫发作

正确答案：E。癫痫发作

解析：垂体腺瘤临床表现为性功能减退，溢乳（C对）。生长激素瘤临床表现肢端肥大症（D对）。垂体瘤占位病变可向前上方压迫视神经交叉（A对），主要表现为颞侧偏盲或双颞侧上方偏盲（B对）。垂体瘤不引起癫痫发作（E错，为本题正确答案）。但第九版内科学（P656）“肿瘤可偶尔扩展至额叶或颞叶，引起癫痫样抽搐、偏瘫、锥体束征及精神症状”（E对），故本题无答案。